可用于抗动脉粥样硬化的药物有
A. 消胆胺
B. 硝普钠
C. 安妥明
D. 烟酸
E. 肼苯达嗪

正确答案：A、C、D。消胆胺；安妥明；烟酸

解析：本题考查用于抗动脉粥样硬化的药物。可用于抗动脉粥样硬化的药物有消胆胺（A对）、安妥明（C对）、烟酸（D对）。硝普钠（B错）及肼屈嗪（肼苯哒嗪）（E错）为血管扩张药，用于抗高血压。